为提高筛检试验的灵敏度，对几个独立试验可以
A. 串联使用
B. 并联使用
C. 先申联后并联使用
D. 要求每个试验的假阳性率低
E. 要求每个试验的特异度低

正确答案：B。并联使用